患者，男，56岁。喘咳气急，胸部胀闷，不得卧，痰稀白量多，恶寒发热，无汗，舌苔薄白，脉浮紧。其治疗应首选
A. 麻黄汤
B. 木防己汤
C. 苓桂术甘汤
D. 越婢加半夏汤
E. 葶苈大枣泻肺汤

正确答案：A。麻黄汤

解析：题中患者以喘咳气急，胸部胀闷为主症，故诊断为喘证。咳喘气急，胸部胀闷，不得卧为外感风寒，内合于肺，寒邪闭肺，肺郁不宣，肺气上逆所致。寒为阴邪，寒邪伤肺，故痰稀白量多；风寒束表，卫阳被遏，故恶寒发热，无汗；舌苔薄白，脉浮紧为表寒之象，故辨为风寒壅肺证。治宜宣肺散寒，化痰平喘，首选麻黄汤合华盖散加减（A对）。木防己汤功能行水散结，补虚清热，用于膈间支饮的治疗（B错）。苓桂术甘汤功能温阳化饮，健脾利湿，主治中阳不足之痰饮（C错）。越脾加半夏汤功能清热宣肺，化痰平喘，为哮病热哮证的选方（D错）。葶苈大枣泻肺汤功能泻肺行水，下气平喘，主治痰水壅实之咳喘胸满，多用于饮证的治疗（E错）。